关于艾滋病，错误的说法是
A. 艾滋病的病原体是获得性免疫缺陷病毒
B. 艾滋病的潜伏期长
C. 艾滋病病毒感染者人数明显高于艾滋病患者数
D. 艾滋病只通过同性恋传播
E. 艾滋病是性病的一种

正确答案：D。艾滋病只通过同性恋传播